在饮水氟含量过高，有地氟病流行的地区，不推荐使用含氟牙膏是
A. 6岁以下儿童
B. 7岁以下儿童
C. 8岁以下儿童
D. 9岁以下儿童
E. 10岁以下儿童

正确答案：A。6岁以下儿童

解析：本题考查氟牙症的防治。在饮水氟含量过高，有地氟病流行的地区，不推荐使用含氟牙膏是6岁以下儿童（A错，为本题正确答案）。由于牙齿发育期，摄入过量的氟可能会通过减少釉基质蛋白分泌,干扰成釉细胞的调节机制，以及影响牙釉质基质蛋白的降解，从而影响牙釉质的发育，牙釉质矿化程度减低、孔隙增多可引起牙齿色泽和表面形态的改变，导致氟牙症。儿童五岁以前，恒牙的牙胚就已开始陆续钙化，至六岁已发育完成，因此六岁以上7岁以下儿童（B对）儿童在高氟地区也可使用含氟牙膏，同理6岁～10岁以下儿童（CDE对）均可使用含氟牙膏。